推荐与吸入性糖皮质激素联合使用，尤其适合于中、重度持续哮喘患者长期治疗的药物是
A. 磷酸二酯酶抑制剂
B. 白三烯受体阻断剂
C. 长效β₂受体激动剂
D. M胆碱受体阻断剂
E. 吸入性糖皮质激素

正确答案：C。长效β₂受体激动剂

解析：本题考查长效β₂受体激动剂。推荐与吸入性糖皮质激素联合使用，尤其适合于中、重度持续哮喘患者长期治疗的药物是长效β₂受体激动剂（C对）。长效β₂受体激动剂不推荐单独使用，须与吸入型肾上腺皮质激素联合应用，不适合初始用于快速恶化的急性哮喘发作，仅用于需要长期用药的患者。磷酸二酯酶抑制剂(A错）是一种抑制磷酸二酯酶活性的药物，选择性的磷酸二酯酶3，4，5抑制剂在心衰、哮喘、阳痿等疾病中，具有广泛的应用前景。白三烯受体阻断剂（B错）对人体支气管平滑肌的收缩作用较组胺、血小板活化因子（PAF）强约1000倍，它尚可刺激黏液分泌，增加血管通透性，促进黏膜水肿形成。伴有前列腺增生的哮喘患者不宜选用M胆碱受体阻断剂（D错）。吸入性糖皮质激素（E错）是哮喘长期治疗的首选药物。